某公司员工36岁，因感冒去医院看病，医生帮他测量血压。这是
A. 医疗性体检
B. 社会性体检
C. 机会性筛检
D. 定期健康体检
E. 随机性筛检

正确答案：A。医疗性体检

解析：该患者因感冒去看病，医生帮忙测血压是医疗服务过程中的一项体格检查，是以疾病诊治为目的体检，属于医疗性体检（A对）。健康体检是疾病普查的常用方法之一：①医疗性体检（A对）：是以诊治患者的疾病为目的的体检。②社会性体检（B错）：是指人在进行相关社会活动（如办理入职、入学、出国、结婚等）时，需要进行的体检。③定期健康检查（D错）：是指按一定的时间间隔进行的健康检查。筛查的对象很明确是健康的人群，而在本题中该员工“因感冒”就医，可见机会性筛检（C错）、随机性筛检（E错）均不符合题意。